男，42岁，呕吐、腹泻两天，意识模糊、烦躁不安半天急诊入院。查体：BP110/70mmHg，神志恍惚，巩膜中度黄染，颈部可见数枚蜘蛛痣，心肺未见异常，腹软，肝肋下未触及，脾肋下3cm，双上肢散在出血点，Hb90g/L，WBC3.2×10⁹/L，血糖7.0mmol/L，尿糖（+），尿酮（-）尿镜检（-）。确诊最有价值的辅助检查是
A. 血气分析
B. 腹部CT
C. 肾功能
D. 肝功能
E. 血氨

正确答案：E。血氨

解析：中年男性患者，巩膜中度黄染、颈部可见数枚蜘蛛痣、双上肢散在出血点（肝功能减退的表现），脾肋下3cm（脾肿大，门静脉高压的表现），提示患者有肝硬化。患者呕吐、腹泻两天（肝硬化引起肝性脑病的诱因），意识模糊、烦躁不安（肝性脑病的表现）半天。综合患者的病史、临床表现、查体检查，可初步诊断为肝性脑病。氨中毒学说是肝性脑病的重要发病机制，约90%患者血氨（E对）增高。血气分析（A错）是抢救危重患者和手术中监护的重要指标之一；肾功能（C错）主要是用于肾脏相关疾病的检查；肝功能（D错）主要用来反映肝脏的功能和受损情况；腹部CT（B错）对于肝性脑病的诊断无明显价值。